《中华人民共和国刑法》规定，生产、销售假药，足以严重危害人体健康的，处
A. 拘役，并处或单处罚金
B. 三年以下有期徒刑，并处或单处罚金
C. 十年以上有期徒刑，并处或单处罚金
D. 无期徒刑，并处或单处罚金
E. 死刑，并处或单处罚金

正确答案：A、B、C。拘役，并处或单处罚金；三年以下有期徒刑，并处或单处罚金；十年以上有期徒刑，并处或单处罚金